反应肝纤维化的血清学指标是
A. 直接胆红素
B. 白蛋白
C. 胆碱酯酶
D. 丙氨酸氨基转移酶
E. Ⅳ型胶原

正确答案：E。Ⅳ型胶原

解析：反应肝纤维化的血清学指标是Ⅳ型胶原（E对），其分布于肝窦内皮细胞下，是构成基膜的主要成分，在肝纤维化过度增生时，CⅣ的含量增加伴随着CⅣ降解酶活性的增加，所以CⅣ得合成和降解均增加，现认为，在肝纤维化早期已有CⅣ的沉积。血清CⅣ及其产物的增加是肝纤维化早期的表现。直接胆红素（P359）（A错）又称结合胆红素，主要用来鉴别黄疸的类型。血清白蛋白（P352）（B错）在维持血液胶体渗透压，体内代谢物质转运及营养等方面其重要作用。胆碱酯酶（C错）主要存在与胆碱能神经末梢突触间隙，主要水解ACh，与肝纤维化无关。丙氨酸氨基转移酶（P363）（D错）主要反映肝细胞损伤，在急慢性病毒性肝炎，酒精性肝炎，肝硬化，肝内、外胆汁淤积等疾病均可升高。